最易导致病位游走不定的外邪是
A. 暑
B. 燥
C. 湿
D. 风
E. 寒

正确答案：D。风

解析：暑为阳邪，其致病具有炎热、升散的特性，能扰神伤津耗气，多挟湿邪（A错）。燥邪致病具有干燥、收敛的特性，其性干涩，易伤津液，并易伤肺脏（B错）。湿邪为阴邪，致病具有重浊、黏滞、趋下的特性，易损伤阳气，阻遏气机（C错）。风为阳邪，其致病具有善动不居、轻扬开泄的特性，易袭阳位，风善行而数变，故致病病位游走不定，病情变幻无常，发病迅速；风性主动，故致病具有动摇不定的特征；风为百病之长，寒、热、暑、湿、燥邪易依附风邪侵犯人体（D对）。寒邪为阴邪，其致病具有寒冷、凝结、收引的特性，易伤阳气（E错）。